以下前牙3/4冠切斜面的要求哪项是错误的
A. 与牙体长轴呈90度角
B. 预备出0.35mm以上间隙
C. 尖牙要形成近远中两个斜面
D. 切斜面内可制备切端沟
E. 下前牙容易暴露金属

正确答案：A。与牙体长轴呈90度角

解析：本题考查前牙3/4冠的牙体预备要求。以下前牙3/4冠切斜面的要求错误的是与牙体长轴呈90度角（A错，为本题的正确答案）。下前牙3/4冠预备近远中方向形成平面，与牙体长轴呈45度。 下前牙只预备切缘的舌侧部分，用轮状车针均匀磨除0.7mm成一小平面（B对），尖牙做成近远中两个小斜面（C对）。切端沟预备（D对）：用倒锥形车针或火焰形车针在切缘预备好的平面上，做出一平行于切嵴的0.5mm宽的切嵴沟，沟的两端与邻面轴沟的开口相连。下前牙预备近远中面和舌面，金属边缘在唇面极易暴露（E对），影响美观。